DNA变性的本质是
A. 磷酸二酯键断裂
B. N-C糖苷键断裂
C. 戊糖内C-C键断裂
D. 碱基内C-C键断裂
E. 互补碱基之间氢键断裂

正确答案：E。互补碱基之间氢键断裂

解析：DNA变性是指在某些理化因素作用下，DNA双链互补碱基之间氢键断裂（E对），解离为单链的过程。DNA变性破坏的是DNA的空间结构，它的一级结构和化学组成没有改变，因此不存在磷酸二酯键的断裂（A错）、N－C糖苷键断裂（B错）、戊糖内C－C键断裂（C错）、碱基内C－C键断裂（D错）。